乳牙初萌时，上唇系带常位于两中切牙之间，随着颌骨发育、牙根生长，上唇系带可退缩至正常位置，表现为
A. 上唇系带位置过低
B. 中切牙间间隙
C. 暂时性远中（牙合）
D. 暂时性前牙拥挤
E. 暂时性深覆（牙合）

正确答案：A。上唇系带位置过低

解析：上唇系带位置过低：乳牙初萌时，上唇系带常位于两中切牙之间，随着颌骨发育、牙根生长，上唇系带可退缩至正常位置。掌握“（牙合）的生长发育”知识点。